下列属于利尿药的是
A. 盐酸氯胺酮
B. 盐酸哌替啶
C. 尼可刹米
D. 呋喃妥因
E. 依他尼酸

正确答案：E。依他尼酸

解析：本题考查利尿药。下列属于利尿药的是依他尼酸（E对）。依他尼酸为高效能利尿药，其他高效利尿药还有呋塞米、布美他尼等。盐酸氯胺酮（A错）为静脉麻醉药。盐酸哌替啶（B错）为强效镇痛药。尼可刹米（C错）为中枢兴奋药。呋喃妥因（D错）是合成抗菌药。